《中国药典》收载的阿司匹林标准中，记载在【性状】项的内容是
A. 含量的限度
B. 溶解度
C. 溶液的澄清度
D. 游离水杨酸的限度
E. 干燥失重的限度

正确答案：B。溶解度

解析：本题考查药品质量标准各项下的内容。《中国药典》收载的阿司匹林标准中，记载在【性状】项的内容是溶解度（B对）。溶解度是《中国药典》收载的阿司匹林标准中，记载在【性状】项的内容。药品质量标准的性状项下还记载药品的外观、臭味及物理常数。含量的限度（A错）是药品质量标准中含量或效价的规定。溶液的澄清度（C错）、游离水杨酸的限度（D错）、干燥失重的限度（E错）为药品质量标准检查项下的内容。